慢性支气管炎有小气道阻塞时，最敏感的肺功能检查指标是
A. 第一秒用力呼气量占用力肺活量的比值减少
B. 残气容积明显增加
C. 呼吸道阻力增加
D. 闭合容量减少
E. 频率依赖性肺顺应性降低

正确答案：E。频率依赖性肺顺应性降低

解析：肺顺应性分为静态顺应性（Cstat）和动态顺应性（Cdyn）两种。静态顺应性反映肺组织的弹性，动态顺应性受气道阻力的影响。动态顺应性又分为正常呼吸频率（20次/分）和快速呼吸频率（约60次/分）两种，后者又称为频率依赖性肺顺应性。频率依赖性肺顺应性是最敏感的小气道功能测定方法。正常情况下Cdyn与Cstat接近，且呼吸频率增加时改变亦很小，但当慢性支气管炎有小气道阻塞时，患者气道阻力增加，呼吸频率增加时，随特定肺容量的改变而胸膜腔内压增加，频率依赖性肺顺应性降低（E对）。慢性支气管炎有小气道阻塞时，可出现呼吸道阻力增加（C错）、残气容积明显增加（B错）和第一秒用力呼气量占用力肺活量的比值（FEV₁.₀）减少（A错），但均不是最敏感的指标。闭合容积减少（D错）与小气道阻塞关系不大。